在牙齿牙釉质的常规磨片当中，人为的造成的裂隙可能被误认为是下列哪种结构
A. 釉牙本质界
B. 釉质牙骨质界
C. 牙本质牙骨质界
D. 釉板
E. 生长线

正确答案：D。釉板

解析：釉板在釉质横断面容易观察，但是在常规磨片中，许多釉板样结构实际上是制片过程中的人为裂隙，这在磨片过程中可以得到证实，此时裂隙（非真正釉板）将消失。掌握“牙釉质”知识点。